《中国药典》一部规定，测定挥发油含量的药材
A. 山药
B. 西洋参
C. 茜草
D. 姜黄
E. 北沙参

正确答案：D。姜黄

解析：本题考查的是姜黄含量测定。《中国药典》一部规定，测定挥发油含量的药材姜黄（D对）。姜黄，按《中国药典》采用高效液相色谱法测定，本品含姜黄素不得少于1.0%；按《中国药典》采用挥发油测定法测定，本品含挥发油不得少于7.0%（mL/g）。西洋参（B错）【含量测定】按《中国药典》采用高效液相色谱法测定，本品含人参皂苷Rg₁、人参皂苷Re和人参皂苷Rb₁的总量不得少于2.0%。